卢德维咽峡炎是指
A. 腐败坏死性龈口炎
B. 化脓性咽峡炎
C. 腐败坏死性口底蜂窝织炎
D. 化脓性扁桃体炎
E. 粒细胞缺乏症

正确答案：C。腐败坏死性口底蜂窝织炎

解析：口底多间隙感染一般指双侧下颌下、舌下以及颏下间隙同时受累。其感染可能是金黄色葡萄球菌为主的化脓性口底蜂窝组织炎；也可能是厌氧菌或腐败坏死性细菌为主引起的腐败坏死性口底蜂窝组织炎，后者又称为卢德维咽峡炎，临床上全身及局部反应均甚严重。掌握“口底多间隙感染”知识点。